主要用于测定鱼、虾等水产品新鲜程度的指标是
A. 挥发性盐基总氮
B. 过氧化值
C. pH
D. 组胺
E. 三甲胺

正确答案：E。三甲胺

解析：本题考查测定鱼、虾等水产品新鲜程度的指标。三甲胺（E对ABCD错）是季胺类含氮物经微生物还原产生的，新鲜鱼虾等水产品和肉中没有三甲
胺，其主要用于测定鱼、虾等水产品的新鲜程度。